男性青春期性发育的第一个信号
A. 睾丸的增大
B. 首次遗精
C. 身高生长突增
D. 阴茎增长
E. 喉结出现

正确答案：A。睾丸的增大